苯作业人员的膳食中应限制摄入的营养素是
A. 优质蛋白质
B. 脂肪
C. 碳水化合物
D. 铁
E. 维生素C

正确答案：B。脂肪

解析：本题考查苯作业人员的膳食中应限制摄入的营养素。苯作业人员的膳食中应限制摄入的营养素是脂肪（B对ACDE错）。因为苯具有强的亲脂性，膳食脂肪含量过高可促进苯在体内的吸收和蓄积，增加机体对苯的敏感性。